龋好发于牙齿的
A. 自洁区
B. 边缘嵴
C. 滞留区
D. 舌面
E. 牙尖

正确答案：C。滞留区

解析：本题考查龋病发生的宿主因素-牙齿。龋好发于牙齿的滞留区（C对）。滞留区菌斑和食物残渣不易清洁，利于细菌增生，长时间易引起龋病。自洁区不易滞留食物残渣，不易发生龋病（A错）。边缘嵴及牙尖不易堆积食物残渣，一般不易发生龋病（BE错）。舌面靠近唾液腺开口，由于唾液的冲刷可清洁食物残渣，很少发生龋坏（D错）。